女，9个月，体重8kg，发热，呕吐，腹泻3天，粪便蛋花汤样，无腥臭味，尿量明显少，精神萎靡，皮肤弹性差，眼凹陷，唇樱红，四肢凉，诊断为婴儿腹泻，血钠132mmol/L。第一天补液总量和张力应为
A. 720ml，1/2张
B. 1040ml，1/3张
C. 1100ml，2/3张
D. 1200ml，1/2张
E. 1400ml，2/3张

正确答案：D。1200ml，1/2张

解析：患儿第一天补液总量和张力应为1200ml，1/2张（D对）。该患儿血钠132mmol/L（正常值为130～150mmol/L），结合患儿的临床表现，可诊断该患儿为腹泻病、等渗性中度脱水，并且不能排除代谢性酸中毒。等渗性脱水补1/2张含钠液，低渗性脱水应补2/3张液（CE错），高渗性脱水应补1/3张液（B错）。患儿补液主要包括生理需要量、累计损失量、继续丢失量。该患儿生理需要量为8kg×100ml/（kg·d）=800ml/d，累计损失量估算约为8kg×50ml/（kg·d）=400ml/d，继续丢失量视患儿腹泻情况而定。因此第一天补液1/2张含钠液，总量应为1200ml（D对A错）。